躯体疾病所致精神障碍临床表现的共同特点，不正确的是
A. 精神症状多有昼轻夜重的波动性
B. 可表现出急性或慢性脑病综合征
C. 精神症状一般发生在躯体疾病的恢复期
D. 病程及预后取决于原发躯体疾病的状况与治疗是否得当
E. 具有躯体疾病的临床表现和实验室阳性发现

正确答案：C。精神症状一般发生在躯体疾病的恢复期

解析：躯体疾病所致的精神障碍在临床表现上有以下共同特点1.精神障碍的发生、发展、严重程度及其转归与躯体疾病的病程变化相一致。2.精神症状在多数情况下具有昼重夜轻的特征（A错，为本题正确答案）。3.精神症状的严重程度一般与躯体疾病的严重程度消长平行（C错，为本题正确答案）；精神障碍的病程、预后与躯体疾病的病程、转归密切相关（D对）。4.患者都具有躯体疾病症状、体征及实验室的某些阳性发现（E对）。躯体疾病所致精神障碍可以可表现出急性或慢性脑病综合征（B对）（八年制第3版精神病学P194）。A选项和C选项说法都不对，原答案为C。